关于胃液分泌的描述错误的是
A. 壁细胞分泌盐酸
B. 主细胞分泌胃蛋白酶
C. 黏液细胞分泌糖蛋白
D. 幽门腺分泌糖蛋白
E. 内因子是壁细胞分泌的

正确答案：B。主细胞分泌胃蛋白酶